引起流行性脑脊髓膜炎的病原菌属于
A. 奈瑟菌属
B. 念珠菌属
C. 隐球菌属
D. 链球菌属
E. 葡萄球菌属

正确答案：A。奈瑟菌属

解析：引起流行性脑脊髓膜炎的病原菌是脑膜炎双球菌，属于奈瑟菌属（A对）。念珠菌属（B错）、隐球菌属（C错）、链球菌属（D错）及葡萄球菌属（E错）均不能引起流行性脑脊髓膜炎。